不属于一级预防（又称病因预防）的是
A. 个人的健康教育
B. 预防接种
C. 医生同患者共同检测疾病
D. 婚前检查
E. 化学预防

正确答案：C。医生同患者共同检测疾病

解析：一级预防针对健康个体的措施有①个人的健康教育（A对），注意合理营养和促进有规律的身体活动，培养良好的生活行为方式和心理健康；②有组织地进行预防接种（B对），提高人群免疫水平，预防疾病；③做好婚前检查（D对）和禁止近亲结婚，预防遗传性疾病；④做好妊娠和儿童期的卫生保健；⑤某些疾病的高危个体服用药物来预防疾病的发生，即化学预防（E对），故答案选C。